下列哪项不是历史性队列研究的特点
A. 比前瞻性队列研究节省人力和物力
B. 研究开始时所研究的疾病已发生
C. 需要随访的时间比前瞻性队列研究短
D. 研究观察的方向是前瞻性的
E. 验证病因假设的能力不及病例对照研究

正确答案：D、E。研究观察的方向是前瞻性的；验证病因假设的能力不及病例对照研究

解析：本题考查队列研究的优点。历史性队列研究的研究对象分组是根据研究开始时研究者已掌握的有关研究对象在过去某个时点的暴露状况的历史材料做出的且研究开始时研究的结局已经出现，则研究观察的方向不是前瞻性的（D错，为本题正确答案）。队列研究由于病因发生在前，疾病发生在后，因果现象发生的时间顺序是合理的，加之偏倚较少，又可直接计算各项测量疾病危险强度的指标，故其检验病因假说的能力较强（E错，为本题正确答案），一般可证实病因联系。历史性队列研究比前瞻性队列研究节省人力和物力（A对）；历史性队列研究在研究开始时所研究的疾病已发生（B对）；历史性队列研究需要随访的时间比前瞻性队列研究短（C对），因为相对前瞻性研究来说，历史性研究是不进行随访的。